温胆片的功能
A. 滋肾平肝
B. 祛风，清热解毒
C. 清热，滋阴，利咽
D. 芳香化湿通鼻窍

正确答案：D。芳香化湿通鼻窍

解析：本题考查温胆片的功能。温胆片的功能是芳香化湿通鼻窍（D对）。。温胆片【功能】芳香化湿，通鼻窍。耳聋左慈丸【功能】滋肾平肝（A错）。千柏鼻炎片【功能】清热解毒，活血祛风（B错），宣肺通窍。玄麦甘桔含片（颗粒）【功能】清热滋阴，祛痰利咽（C错）芩连片【功能】清热解毒，消肿止痛（E错）。